男，15岁。上呼吸道感染后10余天出现腹痛和便血，经泼尼松治疗后好转。但在病程第四周出现尿蛋白（++）红细胞15～20个／Hp，肾功能及血清补体C3正常。下列病例最可能的诊断是
A. 急性链球菌感染后肾小球肾炎
B. 原发性肾病综合征
C. 紫癜性肾炎
D. 急进性肾炎
E. 狼疮性肾炎

正确答案：C。紫癜性肾炎

解析：青少年男性患者（紫癜性肾炎的好发年龄），上呼吸道感染（紫癜性肾炎的诱因之一）后10余天出现腹痛和便血（提示消化系统受累），经泼尼松治疗后好转。但在病程第四周（紫癜性肾炎的潜伏期内）出现尿蛋白（++）红细胞15～20个/Hp（提示肾脏受累），肾功能及血清补体C3正常（可排除急性链球菌感染后肾小球肾炎）。青少年男性，上感后出现消化系统及泌尿系统受累表现，考虑全身性疾病，且泼尼松治疗有效，考虑紫癜性肾炎（C对）。紫癜性肾炎好发于青少年，有1/3病例起病前1～4周有上呼吸道感染史，是过敏性紫癜（以坏死性小血管炎为主要病理改变的全身性疾病，可累及全身多器官）出现肾脏损害时的表现。临床表现除有皮肤紫癜、关节肿痛、腹痛、便血外，主要为血尿和蛋白尿。急性链球菌感染后肾小球肾炎（急性肾小球肾炎）（A错）表现为血尿，轻中度蛋白尿，可伴有一过性肾功能异常，血清补体C3降低，八周内恢复正常。原发性肾病综合征（B错）表现为大量蛋白尿，低蛋白血症，水肿，高血压。急进性肾炎病变（D错）呈进行性肾功能异常，早期出现少尿无尿，病情进展速度快。狼疮性肾炎（E错）是SLE的肾脏损害，好发于育龄女性，除肾脏表现（血尿、蛋白尿、腰痛等）外，常伴典型的肾外表现如颧部红斑（蝶形红斑），盘状红斑，光过敏，口腔溃疡，关节炎，浆膜炎。